男，35岁。反复发作血尿1年，加重3周。多出现在急性咽炎后1～3天。查体：BP150/100mmHg，下肢轻度水肿。尿沉渣镜检：RBC5～10/HP。尿蛋白定量1.25g/L。血肌酐88µmol/L。最可能的肾脏病理诊断是
A. 膜增生性肾小球肾炎
B. 微小病变型肾病
C. 膜性肾病
D. IgA肾病
E. 新月体性肾小球肾炎

正确答案：D。IgA肾病

解析：患者中年男性，反复发作血尿1年，加重3周（IgA肾病起病隐匿，常表现为无症状性血尿）。多出现在急性咽炎后1～3天（有些病人起病前数小时或数日内有上呼吸道或消化道感染等前驱症状）。查体：BP150/100mmHg（20% -50% 病人有高血压），下肢轻度水肿。尿沉渣镜检：RBC5～10/HP（血尿）。尿蛋白定量1.25g/L（蛋白尿）。血肌酐88umol/L。最可能的肾脏病理诊断是IgA肾病（D对）。